易造成蛛网膜下腔出血的疾病是
A. 颅内动脉瘤
B. 后颅凹肿瘤
C. 颞部巨大硬脑膜外血肿
D. 脑挫裂伤
E. 脑膜膨出

正确答案：A。颅内动脉瘤

解析：最易造成蛛网膜下腔出血的病因是颅内动脉瘤（A对）破裂，占到所有病因的50%-80%，血管畸形及后颅凹肿瘤（B错）、颞部巨大硬脑膜外血肿（C错）、脑挫裂伤（D错）、脑膜膨出（E错）、烟雾病等约占蛛网膜下腔出血病因的10%。其余病因不明确者较为少见，约占10%。